糖皮质激素的6α和9α位同时引入卤素原子后，抗炎作用增强，但具有较强的钠潴留作用，只可皮肤局部外用的药物是
A. 醋酸可的松
B. 地塞米松
C. 倍他米松
D. 泼尼松
E. 醋酸氟轻松

正确答案：E。醋酸氟轻松

解析：本题考查糖皮质激素的作用特点。糖皮质激素类代表药物有醋酸可的松、氢化可的松、地塞米松、倍他米松、泼尼松、泼尼松龙和醋酸氟轻松，其中醋酸氟轻松（E对）其6-F使A环稳定性增加，16,17位缩瞳使D环稳定性增加，由于其钠潴留作用较强，只能皮肤局部外用。